正确的是
A. 上直肌使眼球转向上
B. 下直肌使眼球转向下
C. 内直肌使眼球转向内
D. 上斜肌使眼球转向外上
E. 下斜肌使眼球转向外下

正确答案：C。内直肌使眼球转向内

解析：上直肌使眼球转向内上，而非上（A错）；下直肌使眼球转向内下，而非下（B错）；内直肌使眼球转向内（C对）；上斜肌使眼球转向外下，而非外上（D错）；下斜肌使眼球转向外上，而非外下（E错）。